诊断急性出血坏死型胰腺炎最有意义的检查是
A. 血淀粉酶检测
B. 血清甲胎蛋白检测
C. 腹部CT检查
D. 血CEA
E. 血CRP

正确答案：C。腹部CT检查

解析：急性出血坏死型胰腺炎胰腺内有灰白色或黄色斑块的脂肪坏死，出血严重者，胰腺呈棕黑色并伴有新鲜出血，坏死灶外周有炎症细胞浸润。腹部CT（C对）检查可以直接确定有无胰腺炎，胰周炎性改变及胸、腹腔积液，胰腺的坏死程度。血淀粉酶检测（A错）主要用于急性水肿型胰腺炎的诊断，出血坏死型胰腺炎时，血淀粉酶可升高、正常甚至降低，诊断价值不大。血清甲胎蛋白检测（九版诊断学P417）（B错）主要用于肝癌、滋养细胞恶性肿瘤的诊断。血CEA（癌胚抗原）检测（九版诊断学P417）（D错）主要用于胰腺癌、结肠癌、直肠癌、乳腺癌、胃癌、肺癌等的辅助诊断。血CRP（C-反应蛋白）检测（九版诊断学P441）（E错）多用于化脓性感染、心肌梗死、严重创伤、大手术、烧伤、恶性肿瘤等的辅助诊断。